心悸，心前区闷痛，痛引肩背内臂，舌暗，脉涩，证属
A. 心血虚
B. 心阴虚
C. 心气虚
D. 心血瘀阻
E. 心火亢盛

正确答案：D。心血瘀阻

解析：本题考查的是心血瘀阻证的临床表现。心悸，心前区闷痛，痛引肩背内臂，舌暗，脉涩，证属心血瘀阻（D对）。心病主要证候有心气虚证、心阳虚证、心血虚证、心阴虚证、心血瘀阻证及心火亢盛证。1.心气虚（C错）证与心阳虚证的临床表现：心阳虚与心气虚的共有症状是：心悸，气短，自汗，活动或劳累后加重。心气虚证的临床表现，除上述共有症状外，兼见面色白、体倦乏力、舌质淡、舌体胖嫩、苔白、脉虚。心阳虚证的临床表现，除上述共有症状外，兼见形寒肢冷、心胸憋闷、面色苍白、舌淡或紫暗脉细弱或结代。如出现心阳虚脱，除有心阳虚的症状外，兼见大汗淋漓、四肢厥冷、口唇青紫、呼吸微弱、脉微欲绝。2.心血虚（A错）证与心阴虚（B错）证的临床表现：心血虚与心阴虚的共同症状是：心悸，心烦，易惊，失眠，健忘。心血虚证的临床表现，除上述症状外，兼见眩晕、面色不华、唇舌色淡、脉细弱。心阴虚证的临床表现，除上述症状外，兼见低热、盗汗、五心烦热、口干、舌红少津、脉细数。3.心血瘀阻证与心火亢盛（E错）证的临床表现：心血瘀阻证的临床表现，多见心悸，心前区刺痛或闷痛，并常引臂内侧疼痛，尤以左臂痛厥为多见，一般痛势较剧，时作时止，重者并有面、唇、指甲青紫，四肢逆冷，舌质暗红，或见紫色斑点，苔少，脉微细或涩。心火亢盛证的临床表现，多见心中烦热，急躁失眠，口舌糜烂疼痛，口渴，舌红，脉数，甚则发生吐血、衄血。